下列有关四环素牙的叙述中，不正确的是
A. 妊娠和喂母乳的妇女不宜使用四环素类药物
B. 12岁以下的小儿不宜使用四环素类药物
C. 可使用可见光复合树脂修复治疗
D. 可使用贴面修复治疗
E. 可使用高浓度过氧化氢液脱色治疗

正确答案：B。12岁以下的小儿不宜使用四环素类药物

解析：为防止四环素牙的发生，妊娠和喂母乳的妇女，以及7岁以下的小儿不宜使用四环素类药物。对四环素牙处理方法有三种，包括可见光复合树脂修复、贴面修复以及高浓度过氧化氢液脱色治疗。掌握“四环素牙齿”知识点。